奇经八脉是指在十二经脉之外“别道而行”的八条经脉，包括督脉、任脉、冲脉、带脉、阴跷脉、阳跷脉、阴维脉、阳维脉。关于各经脉作用、基本功能的说法，错误的是
A. 督脉调节阳经气血
B. 任脉调节阴经气血
C. 冲脉调节十二经气血
D. 带脉约束诸经为血海
E. 阴阳维脉维系阴阳

正确答案：D。带脉约束诸经为血海

解析：本题考查奇经八脉的作用和基本功能。关于各经脉作用、基本功能的说法，错误的是带脉约束诸经为血海（D错，为本题正确答案）。督脉、任脉、冲脉、带脉的基本功能：1.督脉的基本功能（1）调节阳经气血（A对），故称“阳脉之海”。（2）与脑、髓和肾的功能有关。2.任脉的基本功能（1）调节阴经气血（B对），故称“阴脉之海”。（2）主持妊养胞胎。3.冲脉的基本功能（1）调节十二经气血（C对），故称“十二经脉之海”。（2）冲为血海，有促进生殖之功能，并同妇女的月经有着密切的联系。4.带脉的基本功能（1）约束纵行诸经。（2）主司妇女的带下。奇经八脉，又称“奇经”，是指在十二经脉之外“别道而行”的八条经脉而言，包括督脉、任脉、冲脉、带脉及阴跷脉、阳跷脉、阴维脉、阳维脉在内。奇者，异也。由于奇经八脉在循行上和与内脏的联系上均有别于十二经脉，故称其为“奇经”。